48岁女性，近日自觉背部沿肋间皮肤灼痛，进而出现红疹、疱疹、串连成带状。幼儿时患过水痘。最可能的印象诊断是
A. 肾综合征出血热
B. 带状疱疹
C. 流行性斑疹伤寒
D. 风疹
E. 输血后单核细胞增多症

正确答案：B。带状疱疹